男性，29岁。转移性右下腹痛伴发热36小时入院，诊断为急性阑尾炎。医生查体时，让病人仰卧，使右髋和右大腿屈曲，然后医生内旋其下肢，引起病人右下腹疼痛，提示阑尾炎位置
A. 位于右上腹部
B. 在右下腹麦氏点深面
C. 靠近闭孔内肌
D. 位于腰大肌前方
E. 靠近脐部

正确答案：C。靠近闭孔内肌

解析：青年男性病人，诊断为急性阑尾炎，病人仰卧，右髋和右大腿屈曲，然后被动向内旋转其下肢时，病人右下腹疼痛（闭孔内肌试验阳性），提示阑尾炎靠近闭孔内肌（C对）。阑尾一般位于右下腹，也可高至肝右下方，低至盆腔内，甚至越过中线至左侧（E错）；右上腹疼痛可提示阑尾位于肝右下方（A对）。结肠充气试验阳性（Rovsing征）（P372）和麦氏点压痛、反跳痛可提示阑尾位于右下腹麦氏点深面（B错）。病人左侧卧，使右大腿后伸，引起右下腹疼痛（腰大肌试验阳性），提示阑尾位于腰大肌前方（D错）。